B细胞产生的抗体
A. 中和细菌外毒素
B. 具有调理作用
C. 阻断病原体与靶细胞结合
D. ADCC作用
E. 通过补体的旁路途径发挥溶细胞或溶菌作用

正确答案：E。通过补体的旁路途径发挥溶细胞或溶菌作用